男性，16岁，3天来左膝关节肿胀。自幼于外伤后易出血不止。查体：皮肤粘膜未见出血及紫癜，出血时间2分；凝血时间30分，凝血酶原时间正常，疾病分类应为
A. 纤维蛋白生成障碍
B. 凝血酶生成障碍
C. 血小板异常
D. 凝血活酶生成障碍
E. 血管壁功能异常

正确答案：D。凝血活酶生成障碍

解析：患者青少年男性，自幼有外伤后易出血不止病史，3天来左膝关节肿胀（关节出血），查体：皮肤粘膜未见出血及紫癜（凝血障碍性疾病多见关节出血，皮肤黏膜出血、紫癜罕见），出血时间正常，反映血小板和血管性因素正常（CE错）；凝血酶原时间正常，反映外源性凝血途径正常；凝血时间延长，反映内源性凝血途径异常，故患者可能为FⅧ缺乏引起的血友病甲。FⅧ缺乏可影响内源性凝血途径，导致凝血活酶生成障碍（D对）。纤维蛋白生成障碍（A错）可导致血液高凝，出血时间和凝血时间均缩短；凝血酶生成（B错）属于凝血过程的第二阶段。